湿热和热毒导致的带下过多的治则是
A. 宜垢，宜利
B. 宜清，宜开
C. 宜清，宜泻
D. 宜清，宜利
E. 宜散，宜补

正确答案：D。宜清，宜利

解析：带下过多指带下量明显增多，色、质、气味异常，或伴有局部及全身症状者。湿邪是导致本病的主要原因，但也有内外之别。分为脾虚证、肾阳虚证、阴虚夹湿证、湿热下注证、热毒蕴结证。其中湿热下注证治以清利湿热，佐以解毒杀虫。热毒蕴结证治以清热解毒，二证总的治则是宜清、宜利（D对）。